某女，34岁。患湿热黄疸半月，前日又患热毒泻痢。宜选用的药是
A. 马勃
B. 秦皮
C. 鸦胆子
D. 垂盆草
E. 地锦草

正确答案：E。地锦草

解析：本题考查的是地锦草的主治病证。患湿热黄疸半月，前日又患热毒泻痢。宜选用的药是地锦草（E对）。地锦草：【主治病证】（1）热毒泻痢，疮疖痈肿，毒蛇咬伤。（2）咯血，尿血，便血，崩漏。（3）湿热黄疸。马勃（A错）：【主治病证】（1）风热或肺热之咽喉肿痛、咳嗽失音。（2）血热吐衄，外伤出血。秦皮（B错）：【主治病证】（1）湿热泻痢。（2）赤白带下。（3）目赤肿痛，目生翳膜。鸦胆子（C错）：【主治病证】（1）休息痢（阿米巴痢疾），热毒血痢。（2）疟疾。（3）赘疣，鸡眼（外用）。垂盆草（D错）：【主治病证】（1）疮疡肿毒，毒蛇咬伤，水火烫伤。（2）湿热黄疸，水肿兼热，小便不利。